下列哪种情况属于口腔种植的禁忌证
A. 牙周病患者
B. 年轻人Ⅰ型糖尿病
C. 嗜好烟酒者
D. 妇女和老年人的骨质疏松
E. 颌骨囊肿刮治术后的缺牙区

正确答案：D。妇女和老年人的骨质疏松

解析：本题考查口腔种植的禁忌证。妇女和老年人的骨质疏松（D对）属于口腔种植的禁忌证。妇女和老年人的骨质疏松属于种植的禁忌证，种植成功关键在于形成骨结合，骨质疏松不利于骨结合的形成。牙周病患者在经系统治疗炎症控制后，可以进行口腔种植（A错）。严重糖尿病，血糖过高或已有明显并发症者，因术后易造成感染不可以进行口腔种植，应在糖尿病得到控制后手术；年轻人Ⅰ型糖尿病在病情得到控制后可以进行口腔种植（B错）。嗜好烟酒者只要身体健康，口腔无不可控的炎症，符合种植的适应症，也可以进行口腔种植（C错）。颌骨囊肿刮治术后的缺牙区骨质良好、骨量充足可以进行口腔种植（E错）。